月经的第5～14天，称为
A. 月经期
B. 增殖期
C. 分泌期
D. 分泌晚期
E. 月经周期

正确答案：B。增殖期

解析：增殖期：月经周期第5～14日，相当于卵泡发育成熟阶段。掌握“女性生殖系统生理”知识点。